医疗保健机构为公民提供的婚前卫生咨询服务的内容有
A. 性卫生知识的教育
B. 生育知识的教育
C. 有关婚配、生育保健问题提供医学意见
D. 性病防治知识的教育
E. 有关传染病防治问题提供医学意见

正确答案：C。有关婚配、生育保健问题提供医学意见

解析：本题考查婚前卫生咨询服务的内容。婚前卫生咨询服务的内容包括：有关婚配、生育保健问题提供医学意见（C对ABDE错），根据具体情况及时处理。